患儿，3岁。腹痛、腹泻2天。2天前因过食瓜果，出现腹痛欲泻，泻后痛减，腹胀，嗳腐，呕吐，吐泻物酸臭，舌苔黄腻，脉滑实。诊断为婴幼儿腹泻，其证型是
A. 风寒
B. 湿热
C. 伤食
D. 脾虚
E. 脾肾阳虚

正确答案：C。伤食

解析：本病例已明确诊断腹泻。饮食生冷瓜果，停积不化，壅滞肠胃，气机不畅，故腹胀；不通则痛，故见腹痛，痛则欲泻；泄后积滞减轻，气机得畅，故泻后痛减；饮食内腐，气秽上冲，故嗳腐；呕吐，吐泻物酸臭，舌苔黄腻，脉滑实，皆为饮食积滞之证，故其证候为伤食泻（C对）。风寒泻临床以大便清稀夹有泡沫，臭气不甚，肠鸣腹痛为临床特征（A错）。湿热泻的临床以大便水样，泻下急迫，量多气臭为临床特征（B错）。脾虚泻临床以大便稀溏，色淡不臭，多于食后作泻，时轻时重，腹胀纳呆为临床特征（D错）。脾肾阳虚泻临床以大便澄澈清冷，完谷不化，形寒肢冷为临床特征（E错）。